男性矿工，井下作业时发生塌方砸伤背部，当即倒于地上，下肢无力不能行走，立即来诊。检查见胸腰段后凸畸形并压痛，双下肢不全瘫。感觉异常平面位于双侧腹股沟水平。如果伤后病人腹胀、腹痛、大便秘结，可能是由于
A. 肾脏损伤
B. 直肠损伤
C. 膀胱损伤
D. 便道损伤
E. 腹膜后血肿刺激

正确答案：E。腹膜后血肿刺激

解析：患者背部砸伤后胸腰段后凸畸形、压痛，双下肢不全瘫痪，提示患者胸腰段骨折，脊髓受压。患者感觉异常平面位于双侧腹股沟水平，提示骨折平面位于T12水平，该段脊柱骨折损伤腹膜后大血管常可引起腹膜后血肿，腹膜后血肿可压迫、刺激结肠，从而出现腹胀、腹痛、大便秘结等表现。综上，伤后病人腹胀、腹痛、大便秘结，可能是由于腹膜后血肿刺激（E对）所致。肾脏损伤（P523）（A错）主要临床表现为血尿、疼痛、腰腹部肿块、发热；直肠损伤（P327）（B错）以腹膜炎或血液从肛门排出、尿液中有粪便残渣、尿液从肛门排出为主要表现；膀胱损伤（P527）（C错）主要表现为腹痛、排尿困难、血尿、尿瘘，上述损伤均不会出现腹胀、大便秘结的表现。查阅相关资料，未见有便道损伤（D错）这一诊断。